与头孢曲松钠注射液混合可产生肉眼难以观测到的白色细微沉淀的注射液是
A. 氯化钠注射液
B. 葡萄糖注射液
C. 葡萄糖氯化钠注射液
D. 乳酸钠林格注射液
E. 氯化钾液注射液

正确答案：D。乳酸钠林格注射液

解析：本题考查药物的配伍。头孢曲松钠不能与含钙注射液（葡萄糖酸钙、氯化钙、复方氯化钠注射液、乳酸钠林格注射液（D对）、复方乳酸钠葡萄糖注射液、含钙的静脉营养液）直接混合，因为会导致微粒形成。0.9%氯化钠注射液（A错）、5%葡萄糖注射液（B错）、葡萄糖氯化钠注射液（C错）及氯化钾液注射液（E错）溶解头孢曲松钠时均不会产生沉淀。